男，22岁。咳嗽伴发热3天，给予青霉素静脉滴注抗感染治疗，用药后患者突然出现气急、胸闷、烦躁不安。查体：T38.5℃，P140次/分，R32次/分，BP75/40mmHg。面色苍白，大汗淋漓，两肺可闻及哮鸣音，身体多部位红色皮疹。最可能的原因是
A. 感染性休克
B. 哮喘急性发作
C. 急性呼吸窘迫综合征
D. 过敏性休克
E. 急性左心衰

正确答案：D。过敏性休克

解析：患者接受青霉素治疗后突发气急、胸闷、烦躁不安，心率140次/分，血压75/40mmHg，面色苍白，大汗淋漓，两肺可闻及哮鸣音，身体多部位红色皮疹，考虑药物过敏性休克（D对）。青霉素本身无免疫原性，但其降解产物青霉噻唑醛酸或青霉烯酸，与体内组织蛋白共价结合后，可刺激机体产生特异性IgE，使肥大细胞和嗜碱性粒细胞致敏。当机体再次接触青霉素时，青霉噻唑醛酸或青霉烯酸蛋白可通过交联结合靶细胞表面IgE而触发过敏反应，重者可发生过敏性休克甚至死亡。感染性休克（A错）常继发于革兰阴性杆菌为主的感染，如急性腹膜炎、胆道感染、绞窄性肠梗阻及泌尿系感染等。哮喘急性发作（B错）、急性呼吸窘迫综合征（C错）和急性左心衰（E错）均不会出现多部位红色皮疹。